不属于病毒感染类型的是
A. 慢性病毒感染
B. 慢发病毒感染
C. 潜伏性感染
D. 败血症
E. 隐性感染

正确答案：D。败血症

解析：根据感染后有无临床症状，分为显性感染和隐性感染。隐性感染是指病毒进入机体后，虽然不引起临床症状，但可向外界散播病毒（在流行病学上具有重要意义），且可使机体获得适应性（特异性）免疫而终止感染。显性感染后，根据病毒感染过程、滞留时间及临床症状存在时间长短，分为急性感染（包括潜伏期、发病期和康复或死亡）和持续性感染（感染后，病毒持续存在6个月至数年），后者再分为潜伏感染、慢性感染、慢发病毒感染和急性病毒感染的迟发并发症。败血症，是指细菌进入血液循环，并在其中生长繁殖、产生毒素而引起的全身性严重感染。临床表现为发热、严重毒血症状、皮疹瘀点、肝脾肿大和白细胞数增高等。分革兰阳性球菌败血症、革兰阴性杆菌败血症和脓毒败血症。以抗生素治疗为主，辅以其他治疗方法。预防措施为避免皮肤粘膜受损，防止细菌感染。掌握“病毒传播方式、感染类型、致病机制及免疫”知识点。